病例对照研究的缺点是
A. 不能估计相对危险度
B. 需要样本量大
C. 研究所需时间长
D. 易产生医德问题
E. 回忆时易发生偏倚

正确答案：E。回忆时易发生偏倚